不引起肉芽肿性炎的病原体是
A. 结核杆菌
B. 痢疾杆菌
C. 麻风杆菌
D. 梅毒螺旋体
E. 伤寒杆菌

正确答案：B。痢疾杆菌

解析：引起肉芽肿性炎的病原体主要有：结核杆菌（A对）、麻风杆菌（C对）、梅毒螺旋体（D对）、组织胞浆菌、新型隐球菌、血吸虫。伤寒杆菌（E对）是以巨噬细胞增生为特征的增生性炎症，这种巨噬细胞称为伤寒细胞，伤寒细胞常聚集成团形成伤寒肉芽肿。痢疾杆菌（B错，为本题正确答案）是细菌性痢疾的致病菌，其引起的是纤维蛋白渗出性炎。